拔牙钳喙与牙长轴平行是为了
A. 夹住患牙
B. 省力
C. 防止邻牙损伤
D. 避免牙龈损伤
E. 利于使用扭转力

正确答案：C。防止邻牙损伤

解析：本题考查拔牙钳喙与牙长轴平行的目的。各种牙钳的基本结构是相同的，即由钳柄、关节和钳喙构成。牙钳的安放一般应与患牙的长轴平行，其主要目的是为了防止损伤邻牙（C对）和断根。钳喙是牙钳夹持患牙的部分，钳喙外凸内凹，夹住患牙（A错）是通过内凹面与牙根形成面与面的接触实现；省力（B错）是利于杠杆原理，即牙钳握持时靠近钳柄的末端区，增大牙钳的杠杆机械效率实现；防止牙龈损伤（D错）是通过拔牙前分离牙龈实现；扭转力（E错）只有在拔锥形单根牙时才可使用，这些与钳喙与牙长轴平行无关。